关于上市许可持有人药品销售行为的说法，正确的有
A. 不得向药品零售连锁企业所属门店直接销售药品
B. 不得以展销会、博览会、交易会、订货会、产品宣传会等方式签订药品销售合同
C. 不得委托非药品经营企业销售药品或委托不符合药品经营质量管理规范的企业储存、运输药品
D. 其授权派出的医药代表可以以本企业名义从事学术推广、技术咨询和药品销售业务等活动

正确答案：A、C。不得向药品零售连锁企业所属门店直接销售药品；不得委托非药品经营企业销售药品或委托不符合药品经营质量管理规范的企业储存、运输药品

解析：本题考查的是药品上市许可持有人的经营行为管理要求。关于上市许可持有人药品销售行为的说法，正确的有不得向药品零售连锁企业所属门店直接销售药品（A对）；不得委托非药品经营企业销售药品或委托不符合药品经营质量管理规范的企业储存、运输药品（C对）。药品批发的经营行为管理要求：药品批发企业是指依法持有药品经营许可证，从事将从药品上市许可持有人、药品批发企业处购进的药品，销售给药品上市许可持有人、药品生产企业、药品零售连锁总部、药品零售企业或药品使用单位等药品批发活动的专营或兼营企业。1.药品批发企业药品经营活动：药品批发企业购进药品，应当建立并执行进货检查验收制度，索取、查验、留存《药品经营监督管理办法》规定的供货企业及其授权委托销售人员有关证件资料、销售凭证（保存至超过药品有效期1年，且不得少于5年），在验明药品合格证明和其他标识等证明药品合法性材料后方可购进、销售；不符合规定的，不得购进和销售。药品批发企业应当严格审核药品购货单位资质，按照其药品生产范围、经营范围或诊疗范围向其销售药品。销售药品时，药品批发企业向购进单位提供以下资料：①药品上市许可持有人证明文件（或药品生产许可证、药品经营许可证）和营业执照的复印件；②所销售药品批准证明文件和检验报告书的复印件；③企业派出销售人员授权书复印件；④标明供货单位名称、药品通用名称、上市许可持有人、生产企业、产品批号、产品规格、销售数量、销售价格、销售日期等内容的凭证；⑤销售进口药品的，按照国家有关规定提供相关证明文件。上述资料均应当加盖本企业公章，通过网络核查、电子签章等方式确认的电子版具有同等效力。药品批发企业从事购进、储存、运输、销售药品等药品经营活动应当持续符合药品GSP的要求。2.禁止类行为：药品批发企业在从事药品经营活动中，应当遵循“诚实守信、依法经营”的原则，禁止以任何弄虚作假手段骗取药品经营许可证，尤其是禁止采用聘用“挂证”执业药师骗取药品经营许可证。药品批发企业不得违法回收或参与回收药品，销售回收药品；不得为他人违法经营药品提供场所、资质证明文件、票据等条件；不得接受药品上市许可持有人委托销售后，再次委托销售；不得从非药品上市许可持有人、药品批发企业等单位或个人处购进药品；不得向无合法购药资质的单位或者个人销售药品，尤其是知道或者应当知道他人从事无证经营仍为其提供药品；不得以中药材及初加工产品冒充中药饮片销售，非法加工中药饮片；不得委托不符合药品GSP的企业储存运输药品；不得伪造药品采购来源，虚构药品销售流向，篡改计算机系统、温湿度监测系统数据，隐瞒真实药品购销存记录、票据、凭证、数据等，致使药品购销存记录不完整、不真实，经营行为无法追溯；不得在证、票、账、货、款不能相互对应一致时购销药品；不得有药品未入库，设立账外账，药品未纳入企业质量体系管理，使用银行个人账户进行业务往来等情形；不得将麻醉药品、精神药品和含特殊药品复方制剂流入非法渠道，或者进行现金交易；不得购进销售医疗机构制剂；不得在核准地址以外的场所储存药品；不得违反规定对药品储存、运输及进行温湿度监测；不得擅自改变药品经营许可证许可事项、登记事项；不得以展销会、博览会、交易会、订货会、产品宣传会等方式现货销售药品或赠送药品（B错）；不得不经药品零售连锁总部，直接向药品零售连锁企业门店销售药品；不得向药品零售企业销售禁止零售的药品；不得向非连锁药品零售企业销售第二类精神药品；不得销售药品不开具发票。药品上市许可持有人可授权派出医药代表从事学术推广、技术咨询等活动，但不得要求其承担药品销售任务（D错）。疫苗上市许可持有人不得向除疾病预防控制机构外的其他任何单位或个人销售疫苗。